结核性腹膜炎腹痛规律是
A. 持续性腹痛
B. 疼痛-排便-加重
C. 进食-疼痛-缓解
D. 疼痛-进食-缓解
E. 疼痛-排便-缓解

正确答案：A。持续性腹痛

解析：结核性腹膜炎多表现为脐周、下腹或全腹持续性隐痛（A对）。进食-疼痛-缓解（C错）为胃溃疡的腹痛特点：胃溃疡患者腹痛常因进食刺激胃酸分泌而引起，表现为餐后痛，1～2个小时逐渐缓解。疼痛-进食-缓解（D错）为十二指肠溃疡的腹痛特点：十二指肠溃疡患者多为餐前痛，常因进食中和胃内过多的胃酸，减少胃酸流入十二指肠而疼痛缓解。疼痛-排便-缓解（E错）为肠易激综合征的腹痛特点（P386）。疼痛-排便-加重（B错）少见，一般腹痛于便后缓解，很少加重。